在放线菌感染的病灶组织及脓样物质中，肉眼可见硫磺样颗粒，其实质是
A. 异染颗粒
B. 在组织中形成的菌落
C. 包涵体
D. 质粒
E. 孢子

正确答案：B。在组织中形成的菌落

解析：在患者病灶组织和窦道流出的脓样物质中，可找到肉眼可见的黄色硫磺状小颗粒，称为硫磺样颗粒，是放线菌在病变部位形成的菌落。掌握“放线菌属”知识点。